泌尿系肿瘤中最常见的是
A. 膀胱癌
B. 肾细胞癌
C. 肾盂癌
D. 前列腺癌
E. 阴茎癌

正确答案：A。膀胱癌

解析：泌尿系肿瘤中最常见的是膀胱癌（A对），其次为肾细胞癌（B错），前列腺癌（D错）在欧美国家最常见，肾盂癌（C错）、阴茎癌（E错）均较少见。